属于乳腺癌特殊类型的是
A. 浸润性导管癌
B. 导管原位癌
C. 导管内癌
D. 小管癌
E. 小叶原位癌

正确答案：D。小管癌

解析：乳腺癌大致分为非浸润性癌和浸润性癌两大类，非浸润性癌包括导管内原位癌和小叶原位癌，浸润性癌包括浸润性导管癌，浸润性小叶癌和特殊类型癌，特殊类型癌包括佩吉特病、小管癌、黏液癌、髓样癌伴大量淋巴细胞浸润。所以D正确，导管内癌属于导管内原位癌，不属于特殊类型癌。